职业肿瘤的识别途径包括
A. 临床观察
B. 实验研究
C. 职业性流行病学调查
D. 临床观察、实验研究
E. A、B、C三项

正确答案：E。A、B、C三项

解析：本题考查职业肿瘤的识别途径。识别和判定职业因素的致癌作用主要通过临床观察、实验研究和流行病学调查（E对ABCD错）三种途径。①临床观察：通过肿瘤的临床诊断和认真观察，分析探索肿瘤发生的环境因素，这是识别和判定职业性致癌因素的重要方法；②实验设计：判断某一化学物质是否有致癌性时，如果短期试验阳性，应在动物实验和接触人群中作进一步详细研究，当短期试验和动物实验都获得阳性结果，该结果就可成为该物质是可疑致癌物的证据；③流行病学调查：流行病学调查的研究对象是人群，对于识别和判定某种因素对人类的致癌性可提供最强有力的证据。